脑脊液最终回流入血液是通过
A. 蛛网膜下腔
B. 蛛网膜颗粒
C. 正中孔
D. 外侧孔
E. 正中孔、外侧孔

正确答案：B。蛛网膜颗粒

解析：脑室系统产生的脑脊液在第四脑室经第四脑室正中孔和两个外侧孔（CDE错）流入脑和脊髓周围的蛛网膜下腔（A错），然后脑脊液再沿此腔流向大脑背面的蛛网膜下腔（A错），最后经蛛网膜颗粒（B对）渗透到硬脑膜窦内（主要是上矢状窦），回流入血液中 。